1∶5000的高锰酸钾洗胃液，是指
A. 高锰酸钾5000mg溶于1L水中
B. 高锰酸钾5000mg溶于1ml水中
C. 高锰酸钾5000㎍溶于1ml水中
D. 1g高锰酸钾溶于5000ml水中
E. 1mg高锰酸钾溶于5000ml水中

正确答案：E。1mg高锰酸钾溶于5000ml水中

解析：本题考查高锰酸钾洗胃液。1∶5000的高锰酸钾洗胃液，是指1mg高锰酸钾溶于5000ml水中（E对）。